可大量被角膜吸收的紫外线波长范围为
A. 290～310㎚
B. 288～350㎚
C. 250～320㎚
D. 300～380㎚
E. 220～330㎚

正确答案：C。250～320㎚

解析：本题考查紫外线的波长范围。可被角膜和结膜上皮大量吸收的紫外线波长范围为250～320㎚（C对ABDE错），易引起急性角膜结膜炎，称为“电光性眼炎”，常见于电焊工及接触其他强紫外线辐射的作业者。